五输穴中的合穴主要治疗
A. 喘咳寒热
B. 身热
C. 逆气而泄
D. 体重节痛
E. 心下满

正确答案：C。逆气而泄

解析：《难经·六十八难》云：“井主心下满（E错），荥主身热（B错），输主体重节痛（D错），经主喘咳寒热学（A错），合主逆气而泄（C对）”。综合现代临床的应用情况，井穴多用于急救，荥穴主要用于治疗热证，输穴多主脏病，经穴多主经脉循行部位痛证，合穴多主腑病。